患者，男，52岁。右上腹疼痛2个月，右胁胀满，胁下癥块触痛，烦躁易怒，恶心纳呆，面色微黄不荣，舌暗有瘀斑，苔薄白，脉弦涩。实验室检查：甲胎球蛋白510ng/mL，B型超声波示右肝叶占位性病变，直径5cm。其证型是
A. 热毒伤阴
B. 湿热瘀毒
C. 气滞血瘀
D. 水湿内停
E. 肝脾血瘀

正确答案：C。气滞血瘀

解析：患者右上腹疼痛2个月，右胁胀满，病为胁痛。肝郁日久，气滞血瘀，痹阻胁络，故胁下癥块触痛，烦躁易怒；肝气横逆，易犯脾胃，故见恶心纳呆；面色微黄不荣，舌暗有瘀斑，苔薄白，脉弦涩均为气滞血瘀之侯。实验室检查：甲胎球蛋白510ng/mL，B型超声波示右肝叶占位性病变，可诊断为肝癌气滞血瘀证（C对），治法为疏肝理气，活血化瘀。方药选用逍遥散合桃红四物汤加减。热毒伤阴（A错）表现为尿少色赤，恶风发热。湿热瘀毒（B错）表现为胁下结块坚实，痛如锥刺，脘腹胀满，目肤黄染，面色晦暗，肌肤甲错。水湿内停证（D错）表现为皮肤光亮水肿，身体困重。肝脾血瘀（E错）特点为腹部结块，推之不移，脘腹胀闷，纳呆乏力。